女，25岁，妊娠10周。5日前出现双眼异物感，逐渐加重，并出现畏光流泪，及多量黏液性分泌物，诊断为下沙眼。下列用药正确的是
A. 四环素
B. 氯霉素
C. 红霉素
D. 利福平
E. 链霉素

正确答案：C。红霉素

解析：妊娠期沙眼是孕妇宫颈感染衣原体的危险因素，发现后应及时检测宫颈衣原体。妊娠期沙眼衣原体（CT）感染首选阿奇霉素，也可选用红霉素（C对）。四环素（A错）易使妊娠期妇女易发生肝毒性，孕妇禁用。氯霉素（B错）抑制骨髓造血机能，孕妇慎用。利福平（D错），3个月以内孕妇禁用。链霉素（E错）可穿过胎盘，在脐带血中达到的浓度约与母血中相近，妊娠妇女慎用。